较常出现杵状指（趾）的呼吸系统疾病是
A. 慢性支气管炎
B. 阻塞性肺气肿
C. 支气管哮喘
D. 支气管扩张症
E. 支原体肺炎

正确答案：D。支气管扩张症

解析：在肺部疾病中，杵状指（趾）最常见于肺部肿瘤和慢性脓毒性疾病如支气管扩张症（D对）和肺脓肿，肺内分流（如动静脉瘘）也可引起杵状指。杵状指不常见于慢性支气管炎（A错）、阻塞性肺气肿（B错）或慢性肺结核的病人，如果这类病人出现杵状指，应怀疑肿瘤。支气管哮喘（C错）和支原体肺炎（E错）无杵状指（趾）。